男性，76岁。有阻塞性肺气肿史，咳嗽，咳脓痰，伴气急，加重2周，今晨起神志恍惚。体检：嗜睡，口唇青紫，两肺湿啰音。心率116次/分，律齐，血压180/100mmHg，神经系统检查未见异常。此时最主要的处理是
A. 降压药
B. 用镇静剂
C. 用利尿剂
D. 吸入丙酸倍氯米松
E. 氧疗加呼吸兴奋剂

正确答案：E。氧疗加呼吸兴奋剂